将染疫人收留在指定的处所，限制其活动，并进行观察或治疗，直到消除传染病传播危险，这一措施被称为
A. 拘留
B. 隔离
C. 留验
D. 医学观察
E. 医学检查

正确答案：B。隔离